放射诊疗工作中放射治疗的原理是
A. 指借助医学影像系统进行治疗
B. 利用放射性同位素诊断或治疗
C. 利用电离辐射的生物效应
D. 利用X射线的穿透性
E. 利用核磁共振进行治疗

正确答案：C。利用电离辐射的生物效应

解析：放射诊疗工作按照诊疗风险和技术难易程度分为四类管理：①放射治疗：是指利用电离辐射的生物效应治疗肿瘤等疾病的技术。②核医学：是指利用放射性同位素诊断或治疗疾病或进行医学研究的技术。③介入放射学：是指在医学影像系统监视引导下，经皮针穿刺或引入导管做抽吸注射、引流或对管腔、血管等做成型、灌注、栓塞等，以诊断与治疗疾病的技术。④X射线影像诊断：是指利用X射线的穿透等性质取得人体内器官与组织的影像信息以诊断疾病的技术。掌握“放射诊疗的概念分类及执业条件”知识点。